阿片类镇痛药与硫酸镁合用，可增强中枢抑制，导致的不良反应是
A. 胆绞痛
B. 低血压
C. 便秘
D. 躁狂
E. 多汗

正确答案：B。低血压

解析：本题考查药物的相互作用。阿片类镇痛药与硫酸镁合用，可增强中枢抑制，导致低血压（B对）；阿片类镇痛药是通过作用于中枢神经组织内的阿片受体来解除对疼痛的感受，阿片类受体中的δ受体激动引起血压下降，硫酸镁可抑制中枢神经系统，能够降低颅内压，所以阿片类镇痛药与硫酸镁合用，可增强中枢抑制，导致低血压。